疳疮自然消退的时间
A. 3-8周
B. 2-5周
C. 8-10周
D. 1-2周
E. 半年以上

正确答案：A。3-8周

解析：一期梅毒 疳疮不经治疗，可在3~8周内自然消失，而淋巴结肿大持续较久（A对）。